根据2015版《中国药典》，有小毒的中药是
A. 罂粟壳
B. 麻黄
C. 大黄
D. 艾叶
E. 斑蝥

正确答案：D。艾叶

解析：本题考查的是有毒、小毒中药。根据2015版《中国药典》，有小毒的中药是艾叶（D对）。艾叶有小毒，用量3～9g。外用适量，供灸治或熏洗用。罂粟壳（A错）有毒，用量3～6g。妊娠禁用；易成瘾，不宜常服；儿童禁用；运动员慎用。麻黄（B错）与大黄（C错）不属于毒性中药。斑蝥（E错）有大毒，0.03～0.06g，炮制后多入丸散用。外用适量，研末或浸酒醋，或制油膏涂敷患处，不宜大面积用。妊娠禁用；内服慎用。